不能进行不同临床效果之间的比较，但其结果易于为临床医务人员和公众接受的是
A. 成本效益分析
B. 成本效果分析
C. 最小成本分析
D. 机会成本法
E. 成本效用分析

正确答案：B。成本效果分析